三叉神经分支中的面段又可分为以下几支，除外的是
A. 睑下支
B. 上唇支
C. 下唇支
D. 鼻外侧支
E. 鼻内侧支

正确答案：C。下唇支

解析：面段：于眶下孔处发出睑下支、鼻内侧支、鼻外侧支和上唇支。掌握“三叉神经的分支与分布”知识点。